参与围成胆囊三角的是
A. 肝圆韧带
B. 静脉韧带
C. 第2肝门
D. 肝总管
E. 胆总管

正确答案：D。肝总管

解析：胆囊三角由胆囊管、肝总管(D对)和肝脏面围成。